小丸常用的制备方法是
A. 挤出滚圆法
B. 压制法
C. 复凝聚法
D. 液中析晶法
E. 融熔法

正确答案：A。挤出滚圆法

解析：本题考查小丸的制备方法。小丸的制备方法有沸腾制粒法、喷雾制粒法、包衣锅法、挤出滚圆法（A对）、离心抛射法、液中制粒法等。压制法（B错）是软胶囊剂常用的制备方法。复凝聚法（C错）是微囊的制备方法。液中析晶法（D错）是制粒方法。融熔法（E错）是固体分散体的制备方法。